尿酮体是指
A. β-羟丁酸
B. β-羟丁酸+乙酰乙酸
C. 丙酮酸+乙酰乙酸
D. β-羟丁酸+乙酰乙酸+丙酮酸
E. β-羟丁酸+乙酰乙酸+丙酮

正确答案：E。β-羟丁酸+乙酰乙酸+丙酮

解析：在肝脏中，脂肪酸氧化分解的中间产物乙酰乙酸、β-羟基丁酸及丙酮（E对AB错），三者统称为酮体，在尿中出现这三种物质，称为尿酮体。脏具有较强的合成酮体的酶系（酮体在肝细胞的线粒体中合成。合成原料为脂肪酸β-氧化产生的乙酰CoA.肝细胞线粒体内含有各种合成酮体的酶类，特别是HMGCOA合酶，该酶催化的反应是酮体的限速步骤），但却缺乏利用酮体的酶系，酮体是脂肪分解的产物，而不是高血糖的产物，进食糖类物质也不会导致酮体增多。丙酮酸（CD错）可通过乙酰CoA和三羧酸循环实现体内糖、脂肪和氨基酸间的互相转化，因此，丙酮酸在三大营养物质的代谢联系中起着重要的枢纽作用。